不能做推车是由于哪块肌肉瘫痪所致？
A. 肩胛提肌
B. 胸小肌
C. 前锯肌
D. 菱形肌
E. 斜方肌

正确答案：C。前锯肌

解析：前锯肌（C对）收缩时，拉肩胛骨向前并紧贴胸廓。若该肌瘫痪，则不能做推车动作。